对于钝性分离和锐性分离的方法的说法，下列说法正确的
A. 此两种分离方法在术中应该单独使用
B. 使用此两种分离方法时，无需注意手术的快慢节奏
C. 无论使用哪种方法，均应防止粗暴和意外损伤
D. 解剖分离过程中经常需要完整暴露创面，无需保护
E. 在术中如有需要，可以在空气中长时间暴露

正确答案：C。无论使用哪种方法，均应防止粗暴和意外损伤

解析：这两种分离方法，在术中常交替和结合使用。但无论使用哪种方法，均应防止粗暴和意外损伤，注意手术的快慢节奏，解剖分离过程中要经常用盐水纱布覆盖和保护创面，避免在空气中长时间暴露。掌握“口外手术组织切开、止血及组织分离”知识点。